分离狂犬病病毒最好采取
A. 尿液
B. 咽漱液
C. 血液
D. 脑组织
E. 粪便

正确答案：D。脑组织

解析：犬病病毒是弹状病毒科狂犬病毒属中能引起急性脑组织病变的嗜神经病毒。掌握“狂犬病、人乳头瘤病毒”知识点。